患者女，25岁，活动后气促半年。查体：颧部紫红，心尖区听到局限性舒张期隆隆样杂音，肺动脉瓣区第二心音亢进，应首先考虑的是
A. 主动脉狭窄
B. 肺动脉狭窄
C. 二尖瓣关闭不全
D. 二尖瓣狭窄
E. 二尖瓣关闭不全合并狭窄

正确答案：D。二尖瓣狭窄

解析：视诊：重度二尖瓣狭窄可见“二尖瓣面容”，两颧紫红色，口唇轻度发绀。听诊：心尖区舒张中、晚期低调的隆隆样杂音，肺动脉高压时出现肺动脉瓣区第二心音亢进、分裂（D对）。主动脉瓣狭窄可闻及高调、粗糙的递增-递减型收缩期喷射性杂音，向颈部传导（A错）。肺动脉瓣狭窄听诊时胸骨左缘上部有洪亮的Ⅳ/Ⅵ级以上喷射期收缩期杂音（B错）。二尖瓣关闭不全可闻及心尖部较粗糙的吹风样全收缩期杂音范围广泛（C错）。二尖瓣狭窄合并关闭不全，在症状体征上主要是以肺循环淤血为主，患者会有劳力性的呼吸困难，随着疾病的发展，患者有可能会出现夜间阵发性呼吸困难、端坐呼吸、咳嗽咳粉红色泡沫痰，逐渐的发展为全心衰竭，累及到右心衰（E错）。